小青龙汤的组成药物中含有
A. 黄连
B. 杏仁
C. 细辛
D. 熟地黄
E. 石膏

正确答案：C。细辛

解析：小青龙汤方含麻黄、芍药、细辛（C对）、干姜、炙甘草、桂枝、五味子、半夏，可解表散寒，温肺化饮，主治外寒内饮证。其中干姜辛热、细辛辛温，温肺化饮，兼协麻黄、桂枝解表祛邪。小青龙汤方歌—小青龙汤治水气，喘咳呕哕渴利慰，姜桂麻黄芍药甘，细辛半夏兼五味。